女孩，4岁。反复呕吐3天，突发抽搐1次，食欲差，精神萎靡，肾病综合征病史半年余，长期低盐饮食。其量可能合并
A. 低钙血症
B. 肾静脉血栓
C. 低钠血症
D. 颅内感染
E. 脑血拴形成

正确答案：C。低钠血症

解析：本例患儿反复呕吐3天，突发抽搐1次，食欲差，精神萎靡，肾病综合征病史半年余，长期低盐饮食，其最可能合并低钠血症（C对）。低钙血症（A错）可有抽搐表现，但本病例提示长期低盐饮食，所以合并低钠血症可能性大。肾静脉血栓（B错）有尿颜色改变。颅内感染（D错）有脑膜刺激征。脑血拴形成（E错）多见于老年人。